提示卵巢功能衰竭的指标是
A. FSH＞40U/L，E2＜10～20pg/ml
B. FSH＞10U/L，E2＜10～20pg/ml
C. FSH＞10U/L
D. E2＜10～20pg/ml
E. FSH＞40U/L，E1＜10～20pg/ml

正确答案：A。FSH＞40U/L，E2＜10～20pg/ml